停经10周的宫颈妊娠，其最佳处理是
A. 刮宫术后注射催产素
B. 刮宫术后宫颈塞纱条
C. 必要时输血
D. 术前给予MTX治疗，再予刮宫处理
E. 子宫全切除术

正确答案：D。术前给予MTX治疗，再予刮宫处理

解析：宫颈妊娠产物位于膨大的宫颈管内。确诊后可行刮宫术，但刮宫后颈管不易收缩，胎盘血窦不易关闭容易引起大出血，术前应做好输血准备，术后用纱布条填塞宫颈管创面以止血，若出血不止，可行双侧髂内动脉结扎。若效果不佳，则应及时行全子宫切除术，以挽救患者生命。为了减少刮宫时出血并避免切除子宫，近年常采用术前给MTX治疗。掌握“异位妊娠”知识点。